致癌物的最终确定应该依据
A. 致突变试验，动物致癌试验，流行病学调查
B. 构效分析，致突变试验，动物致癌试验
C. 流行病学调查，剂量反应关系，动物致癌试验
D. 恶性转化试验，动物致癌试验，流行病学调查

正确答案：C。流行病学调查，剂量反应关系，动物致癌试验

解析：本题考查致癌物的最终确定依据。致癌物的最终确定应该依据流行病学调查，剂量反应关系，动物致癌试验（C对ABD错）。